关于肌上皮细胞，错误的叙述是
A. 位于腺上皮和基底膜之间
B. 具有收缩功能
C. 又称为篮细胞
D. 常规切片中容易辨认
E. 细胞内充满肌微丝

正确答案：D。常规切片中容易辨认

解析：本题考查肌上皮细胞。关于肌上皮细胞，错误的是常规切片中容易辨认（D错，为本题的正确答案）。肌上皮细胞主要位于腺上皮与基底膜之间（A对）；具有收缩功能（B对），协助腺泡或导管排出分泌物；又称篮细胞（C对）；在细胞突起内充满肌微丝（E对）；常规切片中，此细胞难以辨认，若新鲜腺组织经过锇酸处理，则肌上皮细胞清晰可见。因其胞质内含有活性很强的ATP酶和碱性磷酸酶，故针对此酶的组织化学染色可见肌上皮细胞的典型形态。